下列疾病的牙龈增生程度：药物性牙龈增生
A. 前牙唇面牙龈肿胀明显，龈乳头呈球状突起
B. 牙龈增生龈乳头呈球状、结节状，牙龈表面可呈桑葚状或分叶状
C. 牙龈鲜红肿大，松软而脆弱，表面呈结节状或分叶状，上皮菲薄呈半透明状
D. 牙龈增生广泛可覆盖部分或整个牙冠，以上颌磨牙腭侧最重
E. 牙龈肿大可覆盖部分牙面，颜色暗红发绀或苍白，组织松软脆弱，极易出血

正确答案：B。牙龈增生龈乳头呈球状、结节状，牙龈表面可呈桑葚状或分叶状

解析：本题考查牙龈病的龈增生程度。药物性牙龈增生牙龈增生龈乳头呈球状、结节状，牙龈表面可呈桑葚状或分叶状（B对）。前牙唇面牙龈肿胀明显，龈乳头呈球状突起为（A错）为青春期龈炎。牙龈鲜红肿大，松软而脆弱，表面呈结节状或分叶状，上皮菲薄呈半透明状（C错）为浆细胞性龈炎。牙龈纤维瘤病牙龈增生广泛可覆盖部分或整个牙冠，以上颌磨牙腭侧最重（D错）。牙龈肿大可覆盖部分牙面，颜色暗红发绀或苍白，组织松软脆弱，极易出血（E错）为白血病的龈病损。